具有吞噬功能的细胞是
A. 中性粒细胞
B. NK细胞
C. Th细胞
D. CTL
E. 浆细胞

正确答案：A。中性粒细胞